脊髄灰质炎疫苗初种的年龄是
A. 2个月
B. 3个月
C. 4个月
D. 5个月
E. 6个月

正确答案：A。2个月

解析：脊髄灰质炎疫苗主动免疫对所有小儿均应口服脊髓灰质炎减毒活疫苗糖丸，基础免疫自出生后2月龄（A对）婴儿开始，连服3剂，每次间隔1个月，4岁时加强免疫一次。